血吸虫病病原治疗首选的药物是
A. 氯喹
B. 甲苯达唑
C. 酒石酸钠
D. 甲硝唑
E. 吡喹酮

正确答案：E。吡喹酮

解析：吡喹酮（E对）对血吸虫各个发育阶段均有不同程度的杀虫效果，且毒性较低，血吸虫病治疗的首选用药。氯喹（A错）主要用于治疗疟疾急性发作，控制疟疾症状。还可用于治疗肝阿米巴病、华支睾吸虫病、肺吸虫病、结缔组织病等。甲苯达唑（B错）是广谱驱肠虫药，对蛔虫、钩虫、蛲虫、鞭虫、绦虫和粪类圆线虫等肠道蠕虫均有效。酒石酸钠（C错）可治疗胃酸过多。甲硝唑（D错）用于治疗或预防上述厌氧菌引起的系统或局部感染，如腹腔、消化道、女性生殖系、下呼吸道、皮肤及软组织、骨和关节等部位的厌氧菌感染。